G蛋白所指的酶或蛋白质是
A. 蛋白质激酶A
B. 鸟苷酸环化酶
C. 蛋白质激酶G
D. 生长因子结合蛋白-2
E. 鸟苷酸结合蛋白

正确答案：E。鸟苷酸结合蛋白